因配伍禁忌而不宜合用的药组是
A. 益母草膏与妇血康颗粒
B. 妇科千金片与当归四物汤
C. 补中益气丸与金匮顺气丸
D. 附子理中丸与黄连上清片
E. 祛痰止咳颗粒与通宣理肺丸

正确答案：E。祛痰止咳颗粒与通宣理肺丸

解析：本题考查的是含“十八反”“十九畏”药味中成药的配伍禁忌。因配伍禁忌而不宜合用的药组是祛痰止咳颗粒与通宣理肺丸（E对）。临床常用中成药心通口服液、内消瘰疬丸中含有海藻，祛痰止咳颗粒含有甘遂，若与橘红痰咳颗粒、通宣理肺丸、镇咳宁胶囊等含甘草的中成药联用也属禁忌之列。附子理中丸与黄连上清片（D错）联用属于不注意证候的不合理用药。盲目将附子理中丸与黄连上清丸、金匮肾气丸与牛黄解毒片等合用，均属不注意证候的不合理用药。益母草膏与妇血康颗粒（A错）、妇科千金片与当归四物汤（B错）、补中益气丸与金匮顺气丸（C错）的联用效果，2022年考试指南未明确说明。